乳腺炎可出现哪组淋巴结肿大
A. 左锁骨上淋巴结
B. 右锁骨上淋巴结
C. 腋窝淋巴结
D. 滑车上淋巴结
E. 腹股沟淋巴结

正确答案：C。腋窝淋巴结

解析：淋巴结肿大分为全身性和局限性淋巴结肿大，局限性淋巴结肿大是指局限于某一组的淋巴结肿大。常见的为非特异性淋巴结炎，乳腺、胸壁和上肢等部位的炎症可以引起腋窝淋巴结肿大（C对）。左锁骨上淋巴结（A错）肿大多见于腹腔脏器的癌肿，如胃癌、肝癌和结肠癌等的转移。右锁骨上淋巴结（B错）肿大多见于胸腔脏器癌肿，如肺癌、食管癌等。滑车上淋巴结（D错）肿大，常见于非霍奇金淋巴瘤。腹股沟淋巴结（E错）肿大常由下肢、会阴等部位的炎症引起。